女，45岁。反复剑突下疼痛3年，呕吐10天，呕吐物有隔夜宿食。该患者最易发生的电解质和酸碱平衡失调是
A. 高血钾，代谢性碱中毒
B. 低血钾，代谢性碱中毒
C. 低血钾，代谢性酸中毒
D. 高血钾，代谢性酸中毒
E. 低血钙，代谢性碱中毒

正确答案：B。低血钾，代谢性碱中毒

解析：患者中年女性，有剑突下疼痛病史，呕吐隔夜宿食10天，提示幽门梗阻。大量呕吐导致Na⁺、K⁺、H⁺和Cl⁻随胃液大量丧失，一方面肠液中的HCO₃⁻未被H⁺中和即吸收入血，使血浆中的HCO₃⁻增高；另一方面，Cl⁻的丢失使肾近曲小管的Cl⁻减少，机体为了维持离子平衡，代偿性的重吸收HCO₃⁻增加，导致碱中毒；而Na⁺的大量丢失，可使机体在代偿的过程中出现K⁺和Na⁺的交换、H⁺和Na⁺的交换增加，保留了Na⁺而排出了K⁺及H⁺，造成低钾血症和碱中毒。综上所诉，该患者最可能发生的电解质和酸碱平衡失调是低血钾，代谢性碱中毒（B对）。